组成内脏大神经、内脏小神经节前纤维的是由
A. 胸髓第1--5侧角发出
B. 腰髓第1--5侧角发出
C. 胸髓第5-11侧角发出
D. 胸髓第5-腰1侧角发出
E. 胸髓第12-腰髓第3侧角发出

正确答案：C。胸髓第5-11侧角发出

解析：内脏大神经由穿过第5或第6-9胸交感干神经节的节前纤维组成，内脏小神经,由穿过第10-12胸交感干神经节的节前纤维组成（C对）。